第一鳃裂囊肿的囊壁与表皮样囊肿相似，缺乏
A. 淋巴样组织
B. 棕色清亮液体
C. 黏液样物
D. 复层扁平上皮
E. 浓稠胶样物质

正确答案：A。淋巴样组织

解析：第一鳃裂囊肿的囊肿壁内缺乏淋巴样组织，与表皮样囊肿相似。掌握“鳃裂囊肿”知识点。